医疗机构购进药品的要求包括
A. 禁止医务人员自行采购药品
B. 医疗机构采购同一通用名称药品的品种不得超过3种
C. 执行药品进货检查验收制度
D. 坚持质量优先、价格合理的采购原则

正确答案：A、C、D。禁止医务人员自行采购药品；执行药品进货检查验收制度；坚持质量优先、价格合理的采购原则

解析：本题考查的是医疗机构药品采购管理。医疗机构购进药品的要求包括禁止医务人员自行采购药品（A对）；执行药品进货检查验收制度（C对）；坚持质量优先、价格合理的采购原则（D对）。医疗机构药品集中采购管理：1.药品采购品种限制：医疗机构应当按照经药品监督管理部门批准并公布的药品通用名称购进药品。同一通用名称药品的品种，注射剂型和口服剂型各不得超过2种，处方组成类同的复方制剂1～2种。因特殊诊疗需要使用其他剂型和剂量规格药品的情况除外。即按照规定，医院除特殊情况外，每一个通用名药品品牌不能超过两个（B错），只允许同一药品，两种规格的存在。对于医疗机构采购品种的限制，称之为“一品两规”，正因为如此，医疗机构应当加强对购进药品品种的管理，选择优质优价的药品。2.公立医院药品集中采购：医院用药具有品种多、规格全、周转快的特点，因此应适时购进质量合格、价格合理的药品。3.完善药品配送管理：药品可由中标生产企业直接配送或委托有配送能力的药品经营企业配送到指定医院。药品生产企业委托的药品经营企业应在省级药品集中采购平台上备案，备案情况向社会公开。公立医院药品配送要兼顾基层供应，特别是向广大农村地区倾斜。鼓励县乡村一体化配送，重点保障偏远、交通不便地区药品供应。进一步强化短缺药品监测和预警，按区域选择若干医院和基层医疗卫生机构作为短缺药品监测点，及时掌握分析短缺原因，理顺供需衔接，探索多种方式，保障患者基层用药需求。4.加强药品购销合同管理：《国务院办公厅关于进一步改革完善药品生产流通使用政策的若干意见》（国办发〔2017〕13号）规定，卫生健康、商务等部门要制定购销合同范本，督促购销双方依法签订合同并严格履行。药品生产、流通企业要履行社会责任，保证药品及时生产、配送，医疗机构等采购方要及时结算货款。对违反合同约定，配送不及时影响临床用药或拒绝提供偏远地区配送服务的企业，省级药品采购机构应督促其限期整改；逾期不改正的，取消中标资格，记入药品采购不良记录并向社会公布，公立医院2年内不得采购其药品。对违反合同约定，无正当理由不按期回款或变相延长货款支付周期的医疗机构，卫生计生部门要及时纠正并予以通报批评，记入企事业单位信用记录。将药品按期回款情况作为公立医院年度考核和院长年终考评的重要内容。医疗机构应建立并执行进货检查验收制度，验明药品合格证明和其他标识。药品必须要有批准文号和生产批号，应有产品合格证。中药材和中药饮片应有包装并附有质量合格的标志，特殊管理药品和外用药品包装的标签或说明书上应有规定的标识和警示说明，处方药和非处方药的标签、说明书上应有相应的警示语或忠告语，非处方药的包装要有国家规定的专有标识，进口药品要有中文包装和说明书等。不符合规定要求的，不得购进和使用。医疗机构临床使用的药品应当由药学部门统一采购供应。经药事管理与药物治疗学委员会（组）审核同意，核医学科可以购用、调剂本专业所需的放射性药品。其他科室或者部门不得从事药品的采购、调剂活动，不得在临床使用非药学部门采购供应的药品。因临床急需进口少量药品的，应当按照《药品管理法》及其实施条例的有关规定办理。